分布于下肢的内脏神经
A. 仅有副交感神经
B. 有交感神经和副交感神经两种
C. 以副交感神经为主
D. 以交感神经为主
E. 仅有交感神经

正确答案：E。仅有交感神经

解析：交感神经（E对）分布于全身的骨骼肌，副交感神经主要分布于大部分血管、汗腺、竖毛肌、肾上腺髓质。